病变有关
A. 玻璃体
B. 晶状体
C. 色素上皮层
D. 视觉细胞
E. 双极神经元

正确答案：A。玻璃体

解析：玻璃体对视网膜起支撑作用，使视网膜与色素上皮紧贴，故视网膜脱离与玻璃体（A对）病变有关。